体温调节中枢位于
A. 脊髓
B. 延髓
C. 丘脑下部
D. 小脑
E. 大脑皮质

正确答案：C。丘脑下部

解析：体温调节中枢的重要部位是视前区-下丘脑前部。下丘脑又称丘脑下部（C对）。